以下关于海绵状血管瘤的叙述哪项是错误的
A. 表浅肿瘤呈现蓝色或紫色
B. 扪之柔软，可被压缩
C. 有时可扪到静脉石
D. 扪诊有震颤感，听诊有吹风样杂音
E. 体位移动试验阳性

正确答案：D。扪诊有震颤感，听诊有吹风样杂音

解析：本题考查海绵状血管瘤（静脉畸形）。扪诊有震颤感，听诊有吹风样杂音（D错，为本题的正确答案）是动静脉畸形（传统分类称蔓状血管瘤）的典型表现。静脉畸形，传统分类称海绵状血管瘤，好发于颊、颈、眼睑、唇、舌或口底。位置深浅不一，如果位置较深，则皮肤或黏膜颜色正常，表浅肿瘤呈现蓝色或紫色（A对）。边界不清，扪之柔软，可被压缩（B对）。有时可扪到静脉石（C对）。当头低于心脏水平时，病损区充血膨大；恢复正常位置后，肿胀随之缩小，恢复原状，此称为体位移动试验阳性（E对）。